男，76岁。高血压病史1年，血压波动于170～190/60～65mmHg，查体未见明显异常。实验室检查：血常规、尿常规、肾功能、空腹血糖、血脂等均正常。心电图正常。该患者的收缩压控制目标值至少低于
A. 140mmHg
B. 170mmHg
C. 130mmHg
D. 150mmHg
E. 160mmHg

正确答案：D。150mmHg

解析：患者老年男性，各项检查均正常，血压波动于170～190/60～65mmHg，该患者的收缩压控制目标值至少低于150mmHg（D对BCE错），如能耐受可降至140mmHg（A错）以下。